牙龈切除术及牙龈成形术，术后的组织完全愈合需要
A. 1～2周
B. 2～3周
C. 6～7周
D. 1个月
E. 3个月

正确答案：C。6～7周

解析：术后的组织愈合：约在牙龈切除术后2周时临床上牙龈外观正常，正常的龈沟建立，但组织学上的完全愈合则需6～7周，龈沟液的量在术后1周内增加，在约5周时恢复正常。掌握“药物性牙龈肥大”知识点。